全蝎研末内服，成人每次服用量是
A. 0.6g～1g
B. 1.5g～2g
C. 2.5g～4g
D. 4.5g～6.0g
E. 6.5g～10g

正确答案：A。0.6g～1g

解析：本题考查的是桑螵蛸的主治病证。治肾阳虚尿频遗尿宜用桑螵蛸（A对）。桑螵蛸：【主治病证】（1）肾阳亏虚之遗精、滑精，遗尿、尿频，小便白浊，带下。（2）阳痿不育。金樱子（A错）：【主治病证】（1）遗精滑精，尿频遗尿。（2）久泻久痢。（3）崩漏带下。乌梅（B错）：【主治病证】（1）肺虚久咳。（2）久泻久痢。（3）虚热消渴。（4）蛔厥腹痛。（5）崩漏，便血。椿皮（C错）：【主治病证】（1）久泻久痢，湿热泻痢，便血。（2）崩漏，赤白带下。（3）蛔虫病。（4）疮癣作痒。乌贼骨（E错）为海螵蛸的别名。海螵蛸：【主治病证】（1）崩漏下血，肺胃出血，创伤出血。（2）肾虚遗精，赤白带下。（3）胃痛吞酸。（4）湿疮湿疹，溃疡不敛。